能明显缓解甲亢患者交感神经兴奋症状，并能抑制T₄变为T₃，但不引起粒细胞缺乏的药物是
A. 普萘洛尔
B. 甲基硫氧嘧啶
C. 丙基硫氧嘧啶
D. 甲巯咪唑
E. 卡比马唑

正确答案：A。普萘洛尔